通过监测国际标准化比值（INR）调整给药剂量的药物是
A. 茶碱
B. 丙戊酸钠
C. 华法林
D. 地高辛
E. 万古霉素

正确答案：C。华法林

解析：本题考查华法林。通过监测国际标准化比值（INR）调整给药剂量的药物是华法林（C对）。华法林治疗指数窄，使用过程中应监测国际标准化比值（INR），并将其稳定控制在2.0～3.0之间。体重低于50kg患者、老年或肝功能不全患者，需降低剂量，使INR控制在较低的有效水平（1.8～2.5）。茶碱（A错）为磷酸二脂酶抑制剂，不需要通过监测国际标准化比值（INR）调整给药剂量。丙戊酸钠（B错）为广谱的抗癫痫药，对各种癫痫均有效，不需要通过监测国际标准化比值（INR）调整给药剂量。地高辛（D错）属于强心苷类正性肌力药，用于急、慢性心力衰竭，不需要通过监测国际标准化比值（INR）调整给药剂量。万古霉素（E错）属于糖肽类抗菌药物，临床主要用于耐金黄色葡萄球菌或对β-内酰胺类抗菌药物过敏的严重感染。